糖酵解的关键酶是
A. 丙酮酸羧化酶
B. 己糖激酶
C. 果糖二磷酸酶
D. 葡萄糖-6-磷酸酶
E. 磷酸化酶

正确答案：B。己糖激酶

解析：糖酵解的关键酶是己糖激酶（B对），催化葡萄糖磷酸化为葡糖-6-磷酸。丙酮酸羧化酶（P133）（A错）、果糖二磷酸酶（P134）（C错）、葡萄糖-6-磷酸酶（P134）（D错）均为糖异生的关键酶。磷酸化酶（P130）（E错）是糖原分解的关键酶，催化分解α-1，4-糖苷键。